随着时间的发展，龋洞一旦形成，牙齿
A. 有自身修复的可能
B. 经药物抗菌治疗后，有自身修复的可能
C. 经特殊诱导方法处理后，有自身修复的可能
D. 无自身修复的可能
E. 极少有自身修复的可能

正确答案：D。无自身修复的可能

解析：本题考查龋病。龋病是发生在牙齿的慢性细菌性疾病，病变从釉质或牙骨质开始。由于釉质内无细胞和体液循环，新陈代谢很弱，没有基于细胞活动的修复功能，一旦遭到破坏，不能通过细胞再生恢复缺损组织（D对），只能采用人工材料修补缺损。